含有叔丁氨基结构，选择性激动β₂受体的肾上腺素能药物是
A. 肾上腺素
B. 重酒石酸间羟胺
C. 沙丁胺醇
D. 沙美特罗
E. 盐酸麻黄碱

正确答案：C。沙丁胺醇

解析：本题考查β₂受体激动剂药沙丁胺醇。沙丁胺醇（C对）是含有叔丁胺基结构，选择性激动β₂受体的肾上腺素能药物。将异丙肾上腺素苯核3位的酚羟基用羟甲基取代，N原子上的异丙基用叔丁基取代，即可得到沙丁胺醇。沙丁胺醇的侧链氮原子上的叔丁基用一长链的亲脂性取代基取代得到沙美特罗（D错），沙美特罗是一长效β₂受体激动剂。盐酸麻黄碱（E错）对α和β均具有激动作用。肾上腺素（A错）是具有酚羟基结构的药物。重酒石酸间羟胺（B错）主要作用于α受体，用于急性低血压。